我国现行《污水综合排放标准》中对第一类污染物要求在处理设施排放口处采样。它们是指哪一类物质
A. 易引起急性中毒的物质
B. 不易引起慢性中毒物质
C. 易在体内产生蓄积的物质
D. 在环境中容易降解的有机物
E. 易被微生物分解的有机物质

正确答案：C。易在体内产生蓄积的物质

解析：本题考查《污水综合排放标准》的相关内容。《污水综合排放标准》中第一类污染物指能在环境和动植物体内蓄积（C对ABDE错），对人体健康产生长远影响者，包括汞、镉、铬、砷、铅、镍、苯并(a)芘、铍等13种物质。含此类污染物的污水不分行业和污水排放方式，也不分受纳水体的功能类别，一律在车间或车间处理设施排放口采样，其最高允许排放浓度必须达到本标准要求。